进行性血胸的诊断依据不包括
A. 脉快血压持续下降
B. 胸腔引流连续3个小时总量300ml
C. Hb、RBC反复测定呈持续下降
D. 胸膜腔穿刺抽不出血，但X线示胸内阴影增大
E. 经输血补液后血压不回升逐渐下降

正确答案：B。胸腔引流连续3个小时总量300ml

解析：进行性血胸指持续大量出血所致的胸膜腔积血。具备以下征象则提示存在进行性血胸：①持续性脉搏加快、血压降低（A对），或虽经补充血容量后血压仍不稳定（E对）；②胸腔闭式引流量每小时超过200ml，持续3小时（B错，为本题正确答案）；③血红蛋白量、红细胞计数和血细胞比容进行性降低（C对），引流液的血红蛋白量和红细胞计数与周围血相接近，且迅速凝固。进行性血胸持续大量出血超过肺、心包和膈肌运动的去纤维蛋白作用时，胸膜腔穿刺抽不出血，但X线检查可见胸内阴影进行性增大（D对）。